患者，女，35岁，妊娠期补充叶酸，推荐的用法、用量是
A. 0.3g tid
B. 20mg tid
C. 0.5g qd
D. 0.4mg qd
E. 5mg tid

正确答案：D。0.4mg qd

解析：本题考查叶酸的用法用量。备孕补充叶酸，推荐的用法用量是0.4mg qd（D对）。叶酸对生物体的作用主要表现在以下几个方面：参与遗传物质和蛋白质的代谢；影响动物繁殖性能；影响动物胰腺的分泌；促进动物的生长；提高机体免疫力。叶酸临床用于：（1）口服0.4mg规格：①预防胎儿先天性神经管畸形。②妊娠期、哺乳期妇女预防用药。（2）口服5mg规格：①各种原因引起的叶酸缺乏及叶酸缺乏所致的巨幼红细胞贫血。②妊娠期、哺乳期妇女预防给药。③慢性溶血性贫血所致的叶酸缺乏。（3）注射剂：用于各种原因引起的叶酸缺乏及叶酸缺乏所致的巨幼红细胞贫血。